患儿8岁突然出现喘憋、烦躁不安、大汗，不能平卧，既往曾有喘息发作2次，查体：两肺布满哮鸣音，考虑为支气管哮喘，目前治疗首选
A. 糖皮质激素
B. 支气管扩张剂
C. 免疫抑制剂
D. 肥大细胞稳定剂
E. 脱敏疗法

正确答案：B。支气管扩张剂

解析：患儿8岁突然出现喘憋、烦躁不安、大汗，不能平卧，既往曾有喘息发作2次，查体示两肺布满哮鸣音等表现可诊断为儿童哮喘（重度），首选支气管扩张剂（B对），常用β受体激动剂，对于哮喘重度状态的处理除还有氧疗、补液纠酸、镇静。糖皮质激素为抗炎药物（A错），而免疫抑制剂（C错）、肥大细胞稳定剂（D错）及脱敏疗法（E错）等常用于哮喘慢性持续期的治疗，以改善病情预后。